位于咬肌与下颌支之间的是
A. 颞浅间隙
B. 颞深间隙
C. 颞下间隙
D. 翼颌间隙
E. 咬肌间隙

正确答案：E。咬肌间隙

解析：咬肌间隙又称咬肌下间隙，位于咬肌与下颌支之间。掌握“面侧深区及颌面部各间隙的境界”知识点。